治疗高渗性脱水理想的液体是
A. 5%碳酸氢钠液
B. 10%葡萄糖液
C. 0.9%氯化钠液
D. 0.45%氯化钠液
E. 平衡盐溶液

正确答案：D。0.45%氯化钠液

解析：本题考查高渗性脱水的治疗。治疗高渗性脱水理想的液体是0.45%氯化钠液（D对）。5%碳酸氢钠液（A错）常用来治疗严重代谢性酸中毒。10%葡萄糖液（B错）常用于补充能量和体液，低血糖等。0.9%氯化钠液（C错）、平衡盐溶液（E错）常用于治疗等渗性脱水。